苷类又称配糖体，是
A. 单糖与二糖的结合体
B. 单糖与三糖的结合体
C. 糖与非糖的结合体
D. 糖与糖衍生物的结合体
E. 糖与糖醛酸的结合体

正确答案：C。糖与非糖的结合体

解析：本题考查的是苷的定义。苷类又称配糖体，是糖与非糖的结合体（C对）。苷类，即配糖体，是糖（AB错）或糖的衍生物（DE错）如氨基糖、糖醛酸等与另一非糖物质通过糖的端基碳原子连接而成的化合物。